心理测量的误差主要来源有
A. 施测条件
B. 主试者素质
C. 应试者动机
D. 应试者生理状态
E. 以上都是

正确答案：E。以上都是